组成药物中含有熟地、肉桂的方剂是
A. 一贯煎
B. 暖肝煎
C. 肾气丸
D. 炙甘草汤
E. 地黄饮子

正确答案：E。地黄饮子

解析：该题考查地黄饮子的组成。地黄饮子功能滋肾阴，补肾阳，开窍化痰，由熟干地黄、巴戟天、山茱萸、石斛、肉苁蓉、附子、五味子、肉桂、白茯苓、麦门冬、菖蒲、远志组成（E对）。趣记：地黄饮子山茱斛，领子出门昌远归。